秦皮除清热解毒外，又能
A. 疏风平肝
B. 通利关节
C. 燥湿止带
D. 解暑，截疟
E. 明目，止痉

正确答案：C。燥湿止带

解析：本题考查的是秦皮的功效。秦皮除清热解毒外，又能燥湿止带（C对）。秦皮：【功效】清热解毒，燥湿止带，清肝明目。野菊花：【功效】清热解毒，疏风平肝（A错）。土茯苓：【功效】解毒，利湿，通利关节（B错）。青蒿：【功效】退虚热，凉血，解暑，截疟（D错）。蝉蜕：【功效】疏散风热，透疹止痒，明目退翳，息风止痉（E错）。